下列治疗军团菌病的首选药物是
A. 红霉素
B. 四环素
C. 头孢唑啉
D. 青霉素G
E. 氯霉素

正确答案：A。红霉素

解析：本题考查军团菌病的治疗。治疗军团菌病的首选药物是红霉素（A对）。军团菌为革兰阴性杆菌。四环素（B错）是抑制细菌蛋白合成的一类广谱抗生素，可用于治疗多种细菌感染。包括广谱抑菌剂，高浓度时具杀菌作用，对革兰氏阳性菌、阴性菌、立克次体、滤过性病毒、螺旋体属乃至原虫类都有很好的抑制作用；对结核菌、变形菌等则无效。头孢唑啉（C错）为半合成第一代头孢菌素，对革兰阳性菌如金葡菌、溶血性链球菌、肺炎球菌、白喉杆菌及梭状芽胞杆菌等有较强的作用；对革兰阴性菌的作用也较强，特别对克雷白肺炎杆菌有效；但对绿脓杆菌则无效；由于本品对大肠杆菌作用较强，且大部以原形药从肾排出，故对肾盂肾炎及尿路感染疗效好。青霉素G（D错）主要对革兰阳性细菌有效，对大多数革兰阴性杆菌作用较弱。氯霉素（E错）属抑菌性广谱抗生素，是治疗伤寒、副伤寒的首选药，治疗厌氧菌感染的特效药物之一，其次用于敏感微生物所致的各种感染性疾病的治疗。